气温随高度的增加而逐渐下降，这一现象出现在
A. 平流层
B. 电离层
C. 对流层
D. 逸散层
E. 同温层

正确答案：C。对流层

解析：本题考查对流层的特点。对流层（C对ABDE错）是大气圈中最靠近地面的一层，该层的气温随着高度的增加而降低，这是由于对流层的大气不能直接吸收太阳辐射的能量，但能吸收地面反射的能量所致。